长期使用可引起听力减退、肾功能下降的抗结核药物是
A. 乙胺丁醇
B. 吡嗪酰胺
C. 利福平
D. 链霉素
E. 异烟肼

正确答案：D。链霉素

解析：本题考查抗结核药。长期使用可引起听力减退、肾功能下降的抗结核药物是链霉素（D对）。乙胺丁醇（A错）常见视神经损害。吡嗪酰胺（B错）常见关节痛。利福平（C错）可出现烧心、上腹不适、厌食、呕吐、恶心、腹泻、胃肠胀气、黄疸等。异烟肼（E错）发生率较多者有步态不稳或麻木针刺感、烧灼感或手指疼痛（周围神经炎），深色尿、眼或皮肤黄染，食欲不佳、异常乏力或软弱、恶心或呕吐（肝毒性的前驱症状）。